铅、锰、镉、铊等通过生物膜的方式
A. 简单扩散
B. 滤过
C. 主动转运
D. 易化扩散
E. 膜动转运

正确答案：C。主动转运